下列哪种情况通常不出现蛋白尿
A. 精神紧张
B. 高血压
C. 慢性胃炎
D. 心功能不全
E. 妊娠中毒

正确答案：C。慢性胃炎

解析：由于肾小球滤过膜的滤过作用和肾小管的重吸收作用，健康人尿中蛋白质的含量很少，蛋白质定性检查时呈阴性反应。当尿中蛋白质含量增加，普通尿常规检查即可测出，称蛋白尿。精神紧张（A错）时可出现生理性蛋白尿，程度较轻，持续时间短，一般诱因解除后消失。高血压（B错）、妊娠中毒（E错）患者可并发肾功能损害，从而引起蛋白尿。心功能不全（D错）患者进展到晚期可出现蛋白尿、血尿素氮升高并可有肾功能不全的相应症状。慢性胃炎（C对）患者一般肾功能正常，故通常不会出现蛋白尿。